传染病监测的主要内容，以下哪项不正确
A. 收集人口学资料、传染病的发病和死亡及其分布
B. 研究流行因素和流行规律，包括人群的免疫水平、病原体的型别、毒力和耐药性等
C. 媒介昆虫的种类、分布及病原携带状况
D. 评价防疫措施的效果和预测疫情
E. 早期发现、早期诊断和早期治疗

正确答案：E。早期发现、早期诊断和早期治疗